浅昏迷与深昏迷的区别，主要根据
A. 对声、光刺激有无反射
B. 咳嗽、吞咽、睡孔、角膜反射是否正常
C. 呼吸、脉搏是否正常
D. 血压是否正常
E. 大小便是否失禁

正确答案：B。咳嗽、吞咽、睡孔、角膜反射是否正常